注射剂的优点不包括
A. 药效迅速、剂量准确、作用可靠
B. 适用于不能口服给药的病人
C. 适用于不宜口服的药物
D. 可迅速终止药物作用
E. 可产生定向作用

正确答案：D。可迅速终止药物作用